关于锁骨下动脉的描述，错误的是
A. 两侧起源不同
B. 在前斜角肌前面行向外
C. 有分支分布于甲状腺
D. 以前斜角肌为标志分为三段
E. 于第一肋外缘移行为腋动脉

正确答案：B。在前斜角肌前面行向外

解析：左锁骨下动脉起自主动脉弓，右锁骨下动脉起自头臂干（A对）。在胸锁关节的后方（B错，为本题正确答案）行向外。有分支分布于甲状腺（C对）。以前斜角肌为标志分为三段（D对）。穿斜角肌间隙至第1肋外侧缘续为腋动脉（E对）。